热盛伤津动风多见
A. 强硬舌
B. 吐弄舌
C. 短缩舌
D. 痿软舌
E. 胖大舌

正确答案：A。强硬舌

解析：强硬舌多因外感热病,邪入心包,扰乱心神,致舌无主宰；或热盛伤津,筋脉失养,使舌体失其柔和之性,故见强硬；或肝风夹痰,风痰阻滞舌体脉络等,亦可使舌体强硬不灵（A对）。